为避免服用特拉唑嗪时发生“首剂现象”，应注意首次日剂量不宜超过
A. 1mg
B. 2mg
C. 4mg
D. 8mg
E. 16mg

正确答案：A。1mg

解析：本题考查特拉唑嗪的使用。为避免服用特拉唑嗪时发生“首剂现象”，应注意首次日剂量不宜超过1mg（A对）。肾上腺素能α受体阻断剂在服用首剂或增加剂量12h内，或在停药时，可出现眩晕、虚弱或低血压，称为“首剂现象”。为避免特拉唑嗪发生“首剂现象”，首次剂量一日不超过1mg。